结构中有手性碳，其R和S异构体药效和药动力学性质存在明显差异的心律失常药物是
A. 盐酸普鲁卡因胺
B. 奎尼丁
C. 多非利特
D. 盐酸普罗帕酮
E. 胺碘酮

正确答案：D。盐酸普罗帕酮

解析：本题考查普罗帕酮。普罗帕酮（D对）有R异构体和S异构体，在阻断β受体方面，S-型异构体为R-型异构体的100倍；盐酸普鲁卡因胺、奎尼丁是ⅠA类抗心律失常药。盐酸普鲁卡因胺（A错）、多非利特（C错）、胺碘酮（E错）均不含手性碳；奎尼丁（B错）的异构体奎宁为抗疟药。